分析同一时期不同年龄组某疾病死亡率的变化时，适合采用
A. 出生队列分析
B. 交叉分析
C. 横断面分析
D. 年龄死亡相关分析
E. 抽样调查

正确答案：C。横断面分析

解析：本题考查横断面分析。横断面分析（C对ABDE错）主要分析同一时期不同年龄组或不同年代各年龄组的发病率、患病率或死亡率的变化。